小鼠器官发生期自受精日计是
A. 1～3天
B. 4～6天
C. 6～15天
D. 17～18天
E. 19～21天

正确答案：C。6～15天